（117～119共用题干）某女性患者，45岁，体检结果显示：血压180/100mmHg，体重68Kg，身高160cm（BMI=26.6），甘油三酯4.5mmol/L，胆固醇5.1mmol/L。针对该患者开出运动处方中，不适合的是
A. 运动频率每周2次，每次20分钟
B. 鼓励参加自行车、游泳等下肢关节承重小的运动
C. 运动中合理补液
D. 中等至高等强度运动
E. 减重同时加强肌肉力量锻炼

正确答案：D。中等至高等强度运动

解析：该患者血压180/100mmHg，BMI=26.6属于超重患者伴有3级高血压，应进行有氧、中低强度强度运动，持续10分钟以上的活动（A对）；为了减少减体征期间肌肉和骨骼等瘦体重成分丢失，每周进行2～3次肌肉力量训练；鼓励参加自行车、游泳等下肢关节承重小的运动（B对）；在大量出汗的情况下，应合理安排补液（C对）；建议中低强度运动（D错，为本题正确答案）；减重同时加强肌肉力量锻炼（E对）。